躯干和四肢意识性本体感觉传导通路中的第二级神经元胞体在
A. 薄束核和楔束核
B. 楔束核
C. 栓状核
D. 黑质
E. 无

正确答案：A。薄束核和楔束核

解析：躯干和四肢意识性本体感觉的精细触觉传导通路该传导路由3级神经元组成：第1级神经元为脊神经节内假单极神经元，第2级神经元的胞体在薄束核和楔束核（A对），第3级神经元的胞体在丘脑后外侧核。